男，65岁。夜间阵发性呼吸困难1个月，喘憋不能平卧2天，无咳嗽咳痰，有陈旧性心肌梗死病史，查体：BP130/90mmHg，心率98次/分，无颈静脉怒张，双肺底可闻及细湿啰音，双下肢无水肿。该患者喘憋的最可能原因是
A. 肺炎
B. 左心衰竭
C. 右心衰竭
D. 心肌炎
E. 支气管哮喘

正确答案：B。左心衰竭

解析：患者有夜间阵发性呼吸困难，喘憋不能平卧，双肺底可闻及细湿啰音，且有陈旧性心肌梗死病史，考虑诊断为左心衰竭。故患者喘憋的最可能原因是左心衰竭（B对）导致的肺部淤血。肺炎（P42）（A错）常有高热，咳嗽、咳痰等肺部感染症状。右心衰竭（P167）（C错）主要以体循环淤血为主要表现，可有颈静脉怒张、双下肢水肿等阳性体征。心肌炎（P270）（D错）患者发病前1～3周常有感染前驱症状，如发热、全身怠倦和肌肉酸痛等，除此之外有心悸、胸痛甚至晕厥等，且以青少年多见。支气管哮喘（E错）典型症状为发作性伴有哮鸣音的呼气性呼吸困难，双肺可闻及广泛的哮鸣音。